45岁妇女，患Ⅱ度子宫脱垂伴阴道前后壁明显膨出。两个月前患乙型肝炎住院治疗50天，现来院咨询避孕方法，应选用
A. 宫内节育器
B. 口服避孕药
C. 安全期避孕
D. 外用避孕药膜
E. 男用阴茎套

正确答案：E。男用阴茎套

解析：45岁女性（患者处于绝经过渡期，是指从开始出现绝经趋势直到最后一次月经的时期，始于40岁，历时1～20年不等），患Ⅱ度子宫脱垂伴阴道前后壁明显膨出。两个月前患乙型肝炎住院治疗50天，现来院咨询避孕方法，应选用男用阴茎套（E对）。绝经过渡期患者仍有排卵可能，此期避孕应选择以外用避孕药为主的避孕方法，可选用男用阴茎套（E对）。绝经过渡期阴道分泌物少，不宜选择避孕药膜（D错）避孕，可选用避孕栓、凝胶剂。不宜选用口服避孕药（B错）及安全期避孕（C错），且急、慢性肝炎为口服避孕药的禁忌证。宫内节育器（A错）不适用于宫颈内口过松、重度陈旧性宫颈裂伤或子宫脱垂的患者。